代谢性酸中毒的常见病因是
A. 挤压综合征
B. 长期饥饿状态
C. 反复呕吐
D. 盐皮质激素过多
E. 长期胃肠减压

正确答案：B。长期饥饿状态

解析：代谢性酸中毒是指细胞外液H⁺增加和（或）HCO₃⁻丢失引起的pH下降，以血浆原发性HCO₃⁻减少为特征的酸碱平衡紊乱，长期胃肠减压（E错）、反复呕吐（C错）均可使富含H⁺等酸性物质的胃液大量丢失引起代谢性碱中毒。长期饥饿状态（B对）使体内糖原耗竭，促使脂肪大量动员供能，机体能量从来源于糖代谢逐渐转化为脂质代谢，产生大量酮体，当血酮体的产生过多时，可发生酮症酸中毒，酮体为血液中固定酸成分亦属于代谢性酸中毒。盐皮质激素过多（D错）将促使肾排钾增加导致低钾血症，继而细胞H⁺-K⁺交换增加使H⁺移向细胞内导致代谢性碱中毒。挤压综合征（A错）也称创伤性横纹肌溶解症，是一种再灌注损害，其由于横纹肌的分解可造成酸中毒、高钾血症并释放大量肌红蛋白，肌红蛋白在酸性尿中可沉淀引起急性肾衰竭，肾脏排酸功能障碍进一步加重酸中毒及相关电解质紊乱，但本题涉及为常见病因，相对而言，长期饥饿状态所造成的代谢性酸中毒更为常见。